以下是干啰音的特点，不正确的是哪一项
A. 部位容易变换
B. 是一种持续时间较长的带乐性的呼吸附加音
C. 音调较高
D. 部位不易变，较恒定
E. 吸气和呼气均可听及，但以呼气时更明显

正确答案：D。部位不易变，较恒定

解析：干啰音是一种持续时间较长的带乐性的呼吸附加音（B对），音调较高（C对），基音频率约300～500Hz。干啰音持续时间较长，吸气及呼气时均可听及，但以呼气时为明显（E对），干啰音的强度和性质易改变，部位容易变换（A对）（D错，为本题正确答案）。